下列不属于含有B族维生素的辅酶的是
A. 磷酸吡哆醛
B. 细胞色素c
C. 辅酶A
D. 四氢叶酸
E. 焦磷酸硫胺素

正确答案：B。细胞色素c